下列哪项不是维护心理健康的原则
A. 面对现实，适应环境
B. 认识自己，悦纳自己
C. 结交知己，与人为善
D. 严格要求，永不满足
E. 挫折磨砺，积极进取

正确答案：D。严格要求，永不满足